下列除哪项外均有脉率快的特点
A. 数
B. 促
C. 滑
D. 疾
E. 动

正确答案：C。滑

解析：滑脉多见于痰湿、食积和实热等病证，其脉象特点为往来流利，应指圆滑，如盘走珠（C错，为本题正确答案）。数脉（A对），频率为每分钟90～120次，脉象特点是脉率较正常为快。促脉（B对）是指脉搏急促，节律不齐，有不规则的停歇。疾脉（D对）的脉象特点是脉搏急促，脉率比数脉更快，相当于每分钟120次以上。动脉（E对）的脉象同时集短、滑、数三种脉象的特点于一体，在关部触及其脉搏搏动尤其明显，应指如豆粒动摇。